药物中无效或低效晶型的检查方法是
A. 熔点测定法
B. 旋光度测定法
C. 紫外分光光度法
D. 红外分光光度法
E. 高效液相色谱法

正确答案：D。红外分光光度法